下列关于角质细胞基底层叙述错误的是
A. 胞核卵圆形，染色深，有分裂繁殖能力
B. 细胞器少，核质比例高
C. 是一层圆柱形或矮柱状的细胞
D. 基底细胞和深部棘层细胞亦称生发层
E. 生发层的细胞含干细胞和扩增分化细胞

正确答案：C。是一层圆柱形或矮柱状的细胞

解析：基底层：位于上皮层的最深面，是一层立方形或矮柱状的细胞。借基底膜与其下方的结缔组织相连。胞核卵圆形，染色深，有分裂繁殖能力，基底细胞和深部棘层细胞亦称生发层，能不断分裂增殖，可补充表层脱落的细胞。生发层的细胞含干细胞和扩增分化细胞。口腔上皮的干细胞位于上皮钉突顶部的基底层细胞中。细胞器少，核质比例高。正常情况下脱落的细胞数量与新生的细胞数量保持平衡。掌握“口腔黏膜基本结构”知识点。